下列属于人畜共患寄生虫病的是
A. 炭疽
B. 旋毛虫病
C. 口蹄疫
D. 猪瘟
E. 结核

正确答案：B。旋毛虫病